胸部叩诊音呈浊鼓音可见于
A. 空洞性肺结核
B. 肺炎充血期
C. 胸膜肥厚
D. 肺气肿
E. 气胸

正确答案：B。肺炎充血期

解析：浊鼓音是一种兼有浊音和鼓音特点的混合性叩诊音，见于肺泡壁松弛，肺泡壁含气量减少的情况，如肺不张、肺炎充血期（B对）或消散期、肺水肿等。空洞性肺结核（A错）、气胸（E错）叩诊为鼓音。 胸膜肥厚（C错）叩诊为浊音或者实音。肺气肿（D错）叩诊为过清音。